按中医治疗学分类对应病证的疗效是
A. 止痛
B. 排脓
C. 清热
D. 蚀疣
E. 涩精

正确答案：D。蚀疣

解析：本题考查的是对病证功效。按中医治疗学分类对应病证的疗效是蚀疣（D对）。按中医治疗学分类：①对因功效：是指某些中药能针对病因起治疗作用。具体包含祛邪、扶正、调理脏腑功效、消除病理产物等。其中，属于祛邪功效的有祛风、散寒、除湿、清热（C错）、泻下、涌吐、解毒、杀虫等；属于扶正功效的有补气、助阳、滋阴、养血等；属于调理脏腑或气血功效的有疏肝、柔肝、宣肺、和中、理气、活血、安神、开窍、潜阳、息风等；属于消除病理产物功效的有消食、利水、祛痰、化瘀、排石、排脓（B错）等。②对症功效：是指某些中药能缓解或消除疾病过程中出现的某些或某种症状，有助于减轻患者痛苦，防止病情恶化，如止痛（A错）、止血、止呕、止咳、平喘、止汗、涩肠止泻、涩精（E错）止遗等。③对病证功效：是指某些中药对疟疾、赘疣、痹证、鼻渊、黄疸、肺痈、绦虫证等病证，具有明显优于它药的疗效，如截疟、蚀疣、祛风湿、通鼻窍、利胆退黄、消痈排脓、驱杀绦虫等。④对现代病症功效：是指某些中药对现代医学所描述的高血压、高脂血症、糖尿病、肿瘤等病症有明显的疗效，而使用传统功效术语又难于表达清楚，故借现代药理学术语来表达，如夏枯草降血压，决明子降血脂，天花粉降血糖，半枝莲抗肿瘤等。